根据《关于做好当前药品价格管理工作的意见》，关于药品价格政策的说法错误的是
A. 以现行药品价格政策为基础，坚持市场在资源配置中的决定性作用
B. 同种药品在剂型、规格和包装等方面存在差异的，按照治疗费用相当的原则，综合考虑临床效果、成本价值、技术水平等因素，保持合理的差价比价关系
C. 麻醉药品和第一类精神药品实行政府定价，其他药品实行政府指导价
D. 麻醉药品和第一类精神药品价格依法实行最高出厂（口岸）价格和最高零售价格管理

正确答案：C。麻醉药品和第一类精神药品实行政府定价，其他药品实行政府指导价

解析：本题考查实行药品市场调节价应当遵循的原则。根据《关于做好当前药品价格管理工作的意见》关于药品价格政策的说法错误的是麻醉药品和第一类精神药品实行政府定价，其他药品实行政府指导价（C错，为本题正确答案）。2019年12月11日，为贯彻落实党中央、国务院关于药品保供稳价工作的决策部署，国家医疗保障局制定了《关于做好当前药品价格管理工作的意见》（医保发）（2019）67号），要求依据《价格法》《药品管理法》，进一步完善药品价格形成机制。以现行药品价格政策为基础，坚持市场在资源配置中起的决定性作用（A对），更好发挥政府作用，围绕新时代医疗保障制度总体发展方向，持续健全以市场为主导的药品价格形成机制。同种药品在剂型、规格和包装等方面存在差异的，按照治疗费用相当的原则，综合考虑临床效果、成本价值、技术水平等因素，保持合理的差价比价关系（B对）。麻醉药品和第一类精神药品价格继续依法实行最高出厂（口岸）价格和最高零售价格管理（D对），研究制定相应的管理办法和具体政策。